促进菌斑堆积的因素中不包括
A. 银汞充填的悬突
B. 银汞充填高点
C. 全冠颈部不密贴
D. 外形凸度过大的冠修复体
E. 带矫正器

正确答案：B。银汞充填高点

解析：本题考查促进菌斑堆积的因素。促进菌斑堆积的因素中不包括银汞充填高点（B错，为本题的正确答案）。银汞合金充填存在高点可引起咬合痛，不会引起菌斑堆积。银汞充填的悬突与冠修复体的外形凸度过大，都是牙齿的外形恢复不良，使食物不能正常的从龈沟排溢，易造成菌斑在龈缘堆积（AD对）。全冠颈部不密贴，食物经缝隙进入牙与修复体之间，不易去除，造成菌斑沉积（C对）。矫治器结构复杂，影响牙齿自洁，易导致菌斑易沉积（E对）。